当AQI指数为250时，表示大气质量为
A. 优
B. 良
C. 轻污染
D. 中度污染
E. 重污染

正确答案：E。重污染

解析：本题考查空气质量指数的相关内容。当AQI指数为250时，表示大气质量为重度污染（E对ABCD错）。